影响氯苯格雷的肝酶（CYP2C19）代谢，从而降低氯吡格雷抗血小板作用的药物是
A. 奥美拉唑
B. 阿米替林
C. 非诺贝特
D. 普萘洛尔
E. 吲达帕胺

正确答案：A。奥美拉唑

解析：本题考查奥美拉唑。氯吡格雷是二磷酸腺苷P2Y12受体阻断剂，为前药，在体内代谢经CYP2C19，约2%的活性成分与血小板P2Y12受体结合，发挥抗血小板作用；奥美拉唑（A对）既是CYP2C19的底物，又是CYP2C19强抑制剂，与氯吡格雷同服，可抑制其生物转换为活性代谢物，不能拮抗血小板聚集而阻止血栓。